男，20岁，腹泻1天，无腹痛、无里急后重，心率110次/分，血压85/45mmHg，其他检查正常，此时的处理为
A. 口服补液
B. 快速静脉补液
C. 糖皮质激素治疗
D. 缓慢静脉补液治疗
E. 抗生素治疗

正确答案：B。快速静脉补液

解析：患者男，20岁，腹泻1天（腹泻致消化液丢失，引起等渗性失水），无腹痛、无里急后重，心率110次/分，血压85/45mmHg，其他检查正常，此时应给快速静脉补液的治疗，其余选项均不对（B对ACDE错）。